男性，40岁。水肿，乏力，腹胀2个月，有乙肝病史，查体：全身水肿，腹壁静脉曲张，腹腔积液征（+），下列哪项与该患者腹腔积液形成无关
A. 钠与水的潴留
B. 毛细血管滤过压增高
C. 血管通透性增加
D. 血浆胶体渗透压降低
E. 淋巴液生成过多

正确答案：C。血管通透性增加

解析：中年男性患者，全身水肿、乏力、腹胀2个月，有乙肝病史，腹壁静脉曲张，腹腔积液，应诊断为肝硬化所致的门静脉高压症。肝硬化患者对醛固酮和抗利尿激素灭能作用减弱，导致钠与水的潴留（A对）。门静脉压力升高，使门静脉系统毛细血管滤过压增高（B对）。肝硬化可致低白蛋白血症，白蛋白低于30g/L时，血浆胶体渗透压降低（D对），毛细血管内液体漏入腹腔。肝淋巴量超过了淋巴循环引流的能力，肝窦内亚增高，淋巴液生成过多（E对）。以上作用共同促进患者腹腔积液的形成。血管通透性增加（C错，为本题正确答案）与该患者腹腔积液形成无关。